胆汁酸使脂类在水中乳化成的细小微团为
A. 1～3μm
B. 3～10μm
C. 10～13μm
D. 13～15μm
E. 15～20μm

正确答案：B。3～10μm

解析：胆汁酸的立体构型具有亲水和疏水两个侧面。这种结构特点赋予胆汁酸很强的界面活性，成为较强的乳化剂，使脂类在水中乳化成3～10μm的细小微团，有利于脂肪的消化。脂类的消化产物又与胆汁酸盐结合，并汇入磷脂等形成直径只有20μm的混合微团，利于通过小肠黏膜的表面水层，促进脂类物质的吸收。掌握“胆汁酸代谢”知识点。